心悸失眠，夜多噩梦，平素胆怯易惊，苔白腻，脉弦滑者，治宜选用
A. 二陈汤
B. 温胆汤
C. 导痰汤
D. 酸枣仁汤
E. 半夏白术天麻汤

正确答案：B。温胆汤

解析：“心悸失眠，夜多噩梦，平素胆怯易惊，苔白腻，脉弦滑”病机属胆胃不和，痰热内扰，故当予以理气化痰，清胆和胃，宜选温胆汤（B对）-半夏为君，燥湿化痰，和胃止呕；臣以竹茹甘淡微寒，清胆和胃，清热化痰，除烦止呕；佐以陈皮、枳实，理气（痰须治气，气顺则痰消）、消痰；茯苓、生姜、大枣，渗湿健脾，以杜生痰之源。二陈汤功用为燥湿化痰，理气和中，主治湿痰证（A错）。导痰汤功用为燥湿祛痰，行气开郁，主治痰厥证（C错）。酸枣仁汤功用为养血安神，清热除烦，主治肝血不足，虚热内扰证（D错）。半夏白术天麻汤功用为化痰息风，健脾祛湿，主治风痰上扰证（E错）。